下列哪项是某肺叶发生肺不张的典型X线表现
A. 中等密度、边界不清的云絮状阴影
B. 密度增高的斑点状或小块状阴影
C. 密度均匀增高的三角形片状阴影
D. 密度增高、边缘清楚、呈散在小花朵状阴影
E. 密度增高的边缘锐利粗乱线条状阴影

正确答案：C。密度均匀增高的三角形片状阴影

解析：肺叶发生肺不张的典型X线表现是密度均匀增高的三角形片状阴影（C对）。中等密度、边界不清的云絮状阴影（A错）多见于大叶性肺炎。密度增高的斑点状或小块状阴影（B错）多见于肺结核。密度增高、边缘清楚、呈散在小花朵状阴影（D错）多见于急性粟粒性肺结核。密度增高的边缘锐利粗乱线条状阴影（E错）多见于气胸。